心绞痛气阴两虚证的治法是
A. 益气温阳，宁心安神
B. 益气养阴，活血通络
C. 养心壮胆，安神定悸
D. 养心滋肾，宁神复脉
E. 益气补血，宁心定悸

正确答案：B。益气养阴，活血通络

解析：心绞痛气阴两虚证的机理气虚无力行血，阴虚脉络不利，致气血壅滞，故见胸闷隐痛，时作时止；心脉失养，故见心悸，故治法当益气养阴、活血通络（B对），方药为益气养阴的生脉散合通阳复脉的炙甘草汤加减。益气温阳，宁心安神（A错）为心阳不足的治法，方用参附汤合桂甘龙牡汤加减；养心壮胆，安神定悸（C错）为心胆气虚的治法，方药为安神定志丸加减；养心滋肾，宁神复脉（D错）为心肾不交的治法，方药用六味地黄丸合黄连阿胶汤加减；益气补血，宁心定悸（E错）为气血两虚的治法，方药选用归脾汤加减。